患者，男，50岁。右下颌膨隆3个月、下唇麻木2周入院。1年前，患者由于右下后牙松动、疼痛，于当地医院拔除患牙，疼痛缓解；3个月前出现右下颌膨隆，2周前出现右下唇麻木。入院查体：一般情况良好。专科检查：右下颌角及下颌体部稍膨隆，表面皮肤色泽正常。开口度、开口型未见明显异常。口内黏膜未见明显改变，未见溃疡、瘘管、糜烂及新生物。右下第一、二磨牙缺失，右下第一、二前磨牙Ⅰ度松动，咬合关系正常。舌运动良好，无疼痛及麻木感，口底、颊黏膜正常，右下唇麻木。双侧腮腺导管口无红肿，分泌物清亮。双侧面颈部未触及肿大淋巴结。曲面体层片示右下颌自下颌角至右下尖牙可见一大小约7.0cm×2.0cm不规则溶骨性破坏区，边界虫蚀状，波及牙槽骨，自髓质向皮质扩展，密度不均。关于中央性颌骨癌下列哪种说法是错误的
A. 好发于下颌骨
B. 早期无自觉症状
C. 多以牙痛、牙松动、拔牙后创口不愈、下唇麻木等就诊
D. 侵犯咀嚼肌可致开口受限
E. 一般不易发生转移，预后良好

正确答案：E。一般不易发生转移，预后良好

解析：中央性颌骨癌可向区域性淋巴结及血液循环转移，预后较差。掌握“中央性颌骨癌及上颌窦癌”知识点。